B细胞分化、发育和成熟的场所是
A. 骨髓
B. 淋巴结
C. 胸腺
D. 脾脏
E. 黏膜淋巴组织

正确答案：A。骨髓

解析：骨髓是各类免疫细胞发生的场所，也是B细胞分化、发育和成熟的场所。掌握“中枢和外周免疫器官”知识点。